桂枝茯苓丸的组成是
A. 桂枝、茯苓、丹皮、芍药、红花
B. 桂枝、茯苓、丹皮、芍药、桃仁
C. 桂枝、茯苳、丹皮、芍药、牛膝.
D. 桂枝、茯苓、丹皮、芍药、丹参’
E. 桂枝、茯苓、丹皮、芍药、莪术

正确答案：B。桂枝、茯苓、丹皮、芍药、桃仁

解析：桂枝茯苓丸  方中桂枝温经通阳，以促进血脉运行而散瘀为君；白芍养肝和营，缓急止痛，或用赤芍活血化瘀消癥为臣；桃仁、丹皮活血化瘀为佐；茯苓健脾益气，宁心安神，与桂枝同用，通阳开结，伐邪安胎为使。诸药合用，共奏活血化瘀，消癥散结之效。方歌：金匮桂枝茯苓丸，桃仁芍药和牡丹；等份为末蜜丸服，缓消百块胎可安。